基底节区出血的典型表现是
A. 意识障碍，病灶对侧偏身瘫痪，双眼向病灶对侧凝视
B. 意识障碍，病灶对侧感觉瘫痪，双眼向病灶对侧凝视
C. 病灶对侧偏身瘫痪、偏身感觉障碍及同向性偏盲
D. 病灶对侧偏身瘫痪、偏身感觉缺失及共济失调
E. 意识障碍病灶对侧同向行性偏盲，双眼向病灶对侧凝视

正确答案：C。病灶对侧偏身瘫痪、偏身感觉障碍及同向性偏盲

解析：脑出血见于基底节区、脑叶、脑干、小脑和脑室等五个主要部位。基底节区出血最常见，约占高血压性脑出血的70%，表现为病灶对侧偏身瘫痪、偏身感觉障碍及同向性偏盲（C对），还可出现双眼球向病灶对侧同向凝视不能（ABE错）。意识障碍（ABE错）可由不同的病因引起，但基底核区出血一般不导致意识障碍（P65）。共济失调（D错）主要见于小脑出血（P84）。